可使乳剂转相的是
A. Zeta电位降低
B. 分散相与连续相存在密度差
C. 微生物及光、热、空气等的作用
D. 乳化剂失去乳化作用
E. 乳化剂类型改变

正确答案：E。乳化剂类型改变

解析：本题考查乳剂。转相是指由于某些条件的变化而改变乳剂类型的现象。由0/W型转变成W/O或发生相反的变化。转相通常是由于乳化剂性质发生改变引起的（E对），如油酸钠本来为O/W型乳化剂，加入足量的氯化钙，可使乳剂转变成W/O型乳剂。ζ电位降低（A错）是乳剂发生絮凝的原因。分散相与连续相存在密度差（B错）是乳剂发生分层的原因。微生物及光、热、空气等的作用（C错）是乳剂发生酸败的原因。乳化剂失去乳化作用（D错）是乳剂发生破裂的原因。